污染物在环境自净中发生的化学反应，不包括
A. 氧化
B. 还原
C. 分解
D. 电解
E. 中和

正确答案：D。电解

解析：本题考查污染物在环境自净中发生的化学反应。环境自净是指在物理、化学和生物作用下，环境中的污染物浓度不断降低和消除的现象。进入环境中的污染物可以通过氧化（A对）、还原（B对）、分解（C对）、中和（E对）和其他化学反应，使有机物无机化，使毒性高的变成毒性低的物质而达到净化。而电解（D错）是物质在电极表面发生氧化还原反应的过程。